可干扰酒精代谢过程，导致双硫仑样反应的药品是
A. 甲硝唑
B. 咪康唑
C. 氟康唑
D. 酮康唑
E. 伊曲康唑

正确答案：A。甲硝唑

解析：本题考查忌饮酒的药品。甲硝唑（A对）可干扰酒精的氧化过程，引起体内乙醛蓄积，导致双硫仑样反应。咪康唑（B错）为广谱抗真菌药，不会产生“双硫仑样反应”。氟康唑（C错）为广谱抗真菌药，不会产生“双硫仑样反应”。酮康唑（D错）为吡咯类抗真菌药，不会产生“双硫仑样反应”。伊曲康唑（E错）为三唑类抗真菌剂，不会产生“双硫仑样反应”。